可出现直立性低血压、眩晕、出汗等“首剂现象”的药物是
A. 卡托普利
B. 普奈洛尔
C. 哌唑嗪
D. 硝苯地平
E. 氯沙坦

正确答案：C。哌唑嗪

解析：本题考查哌唑嗪的不良反应。可出现直立性低血压、眩晕、出汗等“首剂现象”的药物是哌唑嗪（C对）。哌唑嗪首次给药可致严重的体位性低血压、晕厥、心悸等，称“首剂现象”，多见于首次用药90分钟内，发生率高达50%。卡托普利（A错）为血管紧张素转化酶抑制剂，常见的不良反应有干咳、胸痛、上呼吸道症状、肾毒性、血管神经性水肿等。普萘洛尔（B错）为β受体阻断药，常见不良发应有诱发支气管哮喘、外周血管收缩和痉挛、反跳现象等。硝苯地平（D错）为钙通道阻滞剂，不良反应为心功能不全、低血压、面部潮红、下肢及踝部水肿等。氯沙坦（E错）为血管紧张素Ⅱ受体阻断药，不良反应有心悸、心动过速、低血压等。